水痘的临床特点是
A. 发热3~4天出疹，出疹时热度增高
B. 发热3~4天出疹，出疹时热退
C. 发热2～3天出疹
D. 发热或无热，1～2天出疹（根盘红晕不明显）
E. 发热数小时～1天出疹

正确答案：D。发热或无热，1～2天出疹（根盘红晕不明显）

解析：水痘是由水痘时邪引起的一种传染性强的出疹性疾病，可见发热轻微，或无热，鼻塞流涕，喷嚏，咳嗽，起病后1~2天出皮疹，疹色红润，疱浆清亮，可见根盘红晕，但五版教材言红晕不明显（D对）。发热3~4天出疹，出疹时热度增高见于麻疹（A错）。发热3~4天出疹，出疹时热退见于奶麻（B错）。发热2～3天出疹者在儿科疾病中不典型（C错）。发热数小时～1天出疹见于猩红热（E错）。